生物地球化学性疾病的发病特点是
A. 疾病的发生有明显的季节性
B. 疾病的发生有明显的家庭聚集性
C. 疾病的发生有明显的性别差异
D. 疾病的发生有明显的地区性
E. 疾病的发生与营养状态有关

正确答案：D。疾病的发生有明显的地区性

解析：本题考查生物地球化学性疾病的发病特点。生物地球化学性疾病是由于地壳表面化学元素分布的不均匀性，使某些地区的水和（或）土壤中某些元素过多或过少，当地居民通过饮水、食物等途径摄入这些元素过多或过少，而引起某些特异性疾病。此类疾病的发生有明显的地区性（D对ABCE错），在海拔相对较高的山区、丘陵地带，由于土壤、饮水、粮食、蔬菜中碘含量较低，多有碘缺乏病的流行。我国自东北至西南有一条宽阔的缺硒地带，与缺硒有关的克山病和大骨节病在该地区有不同程度的流行。在我国北方十多个省区的干旱、半干旱地区，由于浅层地下水含氟量较高，多有饮水型地方性氟中毒的流行。一些地下水或煤炭含砷量较高的地区，则出现许多慢性砷中毒的病例。